患者，男性，52岁。晚上饱餐饮酒后忽然出现胸骨后压榨性疼痛，持续半小时不缓解，伴出汗、恶心、呕吐来诊。首选检查是
A. 腹部B超
B. 胸部X线
C. 化验血常规
D. 心电图
E. 尿淀粉酶检查

正确答案：D。心电图

解析：本例患者为中老年男性，饱餐后出现胸骨后压榨性疼痛，持续半小时不能缓解应首先初步排除是否有心肌梗死，因此首选心电图（D对）。心肌梗死疼痛部位与心绞痛相仿，但性质更剧烈，持续时间可达数小时，常伴有休克、心律失常及心力衰竭，含服硝酸甘油多不能使之缓解；发作时伴有新的相关症状，如出汗、恶心、呕吐、心悸或呼吸困难。心电图不仅可以帮助诊断，而且根据其异常的严重程度和范围可以提供预后信息，症状发作时的心电图尤其有意义。当患者ST段动态改变（≥0.1mV的抬高或压低）是严重冠脉疾病的表现，可能会发生急性心肌梗死或猝死。急性胰腺炎的临床表现病初可伴有恶心、呕吐，轻度发热，但急性腹痛，常较剧烈，多位于中上腹、甚至全腹，部分患者腹痛向背部放射。腹部超声（A错）是急性胰腺炎的常规初筛影像学检查。尿淀粉酶（E错）在胰腺炎发作12～24小时内升高，在胰腺炎早期无明显意义。